口咽有
A. 咽扁桃体
B. 咽隐窝
C. 梨状隐窝
D. 咽鼓管咽口
E. 会厌谷和腭扁桃体

正确答案：E。会厌谷和腭扁桃体

解析：咽扁桃体(A错)、咽隐窝(B错)、咽鼓管咽口(D错)均为鼻咽的结构，梨状隐窝(C错)为喉咽的结构，会厌谷和腭扁桃体(E对)为口咽的结构。